患儿，20个月。曾患维生素缺乏性佝偻病，经治疗后症状已改善，但方颅，肋串珠仍明显，X线片提示临时钙化带重现，血生化指标已正常，其诊断是
A. 佝偻病活动初期
B. 佝偻病激期
C. 佝偻病恢复期
D. 佝偻病后遗症期
E. 健康儿童

正确答案：C。佝偻病恢复期

解析：患者患维生素缺乏性佝偻病，经治疗后方颅，肋串珠仍明显，X线片提示临时钙化带重现，说明处于佝偻病恢复期（C对E错）。佝偻病活动初期主要表现为神经兴奋性增高，如有烦躁、睡眠不安、易惊、夜啼、多汗等症，并可致枕部脱发而见枕秃。血生化改变轻微，血清（OH）3D，下降，PTH增高、血钙正常或略下降，血磷降低，碱性磷酸酶正常或稍高，骨骼X 线摄片可无异常，或见临时钙化带稍模糊（A错）。激期（活动期）主要表现为骨骺变化和运动机能发育迟缓。（1）骨骼改变①头部…方颅、臀形颅；②胸部∶肋骨与软骨交接处膨大成串珠状…③四肢∶形成严重膝内翻（“O”型）或膝外翻（“X”型），长骨可发生青枝骨折。④脊柱：可致脊柱后凸或侧弯畸形、严重者可伴有骨盆畸形（2）肌肉改变：运动功能发育落后，腹肌张力低下，腹部膨隆如蛙腹。重症患儿神经系统发育落后，表情淡漠，语言发育落后，条件反射形成迟缓；免疫功能低下，易合并感染及贫血。此期血生化及骨骼X线片明显改变。血清（OH）3D，更加下降，血钙正常或下降，血磷下降，碱性磷酸酶明显升高（B错）。后遗症期：多见于2岁以后儿童。因婴幼儿期重症佝偻病可残留不同程度的骨骼畸形。临床症状消失，血生化和X线摄片正常（D错）。